开口度是指患者最大开口时
A. 上下唇之间的距离
B. 上下中切牙切缘之间的距离
C. 上下中切牙龈缘之间的距离
D. 鼻底至颏底的距离
E. 以上都不是

正确答案：B。上下中切牙切缘之间的距离

解析：本题考查开口度。开口度是检查颞下颌关节的一个方法，正常人的开口度为37～45mm，指上下中切牙切缘之间的距离（B对）。鼻底至颏底的距离（D错）即面下1/3的距离是全口义齿修复时需要确定的垂直距离。